构成间接骨连结的颅骨是
A. 舌骨与下颌骨
B. 上颌骨与下颌骨
C. 下颌骨与颞骨
D. 颞骨与颧骨
E. 颞骨与上颌骨

正确答案：C。下颌骨与颞骨

解析：颧骨是由缝或软骨牢固连结形成颅。颞下颌关节是间接连结。直接连接包括Fibrous joint, cartilaginous joint, synostosis. 间接连接又叫关节或滑膜关节。